我国的《商场（店）、书店卫生标准》对以下项目提出了卫生要求，除了
A. 小气候
B. 空气质量
C. 噪声
D. 照度
E. 氨

正确答案：E。氨

解析：本题考查我国的《商场（店）、书店卫生标准》提出卫生要求的项目。我国的《商场（店）、书店卫生标准》对微小气候（A对）、空气质量（B对）、噪声（C对）、照度（D对）等项目提出了卫生要求，除了氨（E错，为本题正确答案）。